肾母细胞瘤典型的临床表现是
A. 血尿
B. 消瘦
C. 发热
D. 腹部巨大肿块
E. 高血压

正确答案：D。腹部巨大肿块

解析：肾母细胞瘤是小儿最常见的恶性肿瘤，多在5岁前发病，腹部巨大肿块（D对）是肾母细胞瘤典型的临床表现。血尿（A错）、消瘦（B错）是泌尿系肿瘤的一般表现，不具有特异性。发热（C错）、高血压（E错）等为副瘤综合征的表现，除可见于肾母细胞瘤外，还可见于肾癌、肺癌等恶性肿瘤。